最易引起血流动力学异常的是
A. 心房扑动
B. 心房颤动
C. 窦性心动过速
D. 阵发性室上性心动过速
E. 持续性室性心动过速

正确答案：E。持续性室性心动过速

解析：持续性室性心动过速（E对）指发作时间超过30秒，需药物或电复律始能终止。由于心室率增快，使心室舒张期缩短，心室舒张末期充盈量减少，心室排血量减少，外周有效循环血量不足而出现血流动力学异常。心房扑动（A错）和心房颤动（B错）的症状主要与心室率的快慢有关，心室率不快时，可无症状和血流动力学障碍，若心室率过快，可发生心绞痛与充血性心力衰竭而出现血流动力学障碍。窦性心动过速（P182）（C错）可见于正常人，频率大多在100～150次/分，一般不会出现血流动力学障碍。阵发性室上性心动过速（P192）（D错）发作突然起始与终止，持续时间长短不一，当心室率过快时，心输出量锐减，外周有效循环血量不足而出现血流动力学异常，但此种情况少见，因此并非最佳答案。